盐酸-镁粉还原反应用于检查
A. 黄酮醇类
B. 皂苷类
C. 香豆素类
D. 醌类
E. 生物碱类

正确答案：A。黄酮醇类

解析：本题考查的是盐酸-镁粉（或锌粉）反应。盐酸-镁粉还原反应用于检查黄酮醇类（A对）。黄酮的盐酸-镁粉（或锌粉）反应：是鉴定黄酮类化合物最常用的颜色反应。多数黄酮、黄酮醇、二氢黄酮及二氢黄酮醇类化合物显橙红色至紫红色，少数显紫色至蓝色。但查尔酮、橙酮、儿茶素则无该显色反应。异黄酮类化合物除少数例外，也不显色。皂苷类（B错）的显色反应：皂苷通常应用的显色反应有Liebermann反应、醋酐-浓硫酸反应、三氯乙酸反应、五氯化锑反应及芳香醛-硫酸或高氯酸反应。香豆素类（C错）的显色反应：（1）异羟肟酸铁反应；（2）三氯化铁反应；（3）Gibb's反应；（4）Emerson反应。醌类（D错）的显色反应：1.Feigl反应；2.无色亚甲蓝显色试验；3.Bornträger's反应；4.Kesting-Craven反应；5.与金属离子的反应。生物碱类（E错）的显色反应：某些生物碱能与一些试剂反应生成不同颜色的产物，这些试剂称为生物碱显色剂。生物碱显色试剂较多，常用的显色剂有Mandelin试剂（1%钒酸铵的浓硫酸溶液）、Macquis试剂（含少量甲醛的浓硫酸）、Frohde试剂（1%钼酸钠或钼酸铵的浓硫酸溶液）。